全口义齿修复应在拔牙多长时间后进行
A. 一周
B. 三周
C. 一个月
D. 三个月
E. 六个月

正确答案：D。三个月

解析：本题考查全口义齿修复的时间。牙槽嵴吸收速率在牙缺失后头3个月最快，大约6个月后吸收速率显著下降，拔牙后两年吸收速度趋于稳定。因此，全口义齿的修复应在拔牙3个月后进行（D对），全口义齿修复过早（ABC错）对牙槽嵴产生压迫而加快牙槽嵴的吸收，出现不规则的骨尖骨嵴等，容易导致义齿固位不良，黏膜压痛等问题。但若过晚（E错）进行义齿修复，牙槽嵴吸收严重，会导致牙槽嵴低平，无法提供足够的义齿固位力。